治疗幽门螺杆菌感染宜选用
A. 双氯西林
B. 替卡西林
C. 阿莫西林
D. 青霉素V
E. 氨苄西林

正确答案：C。阿莫西林

解析：本题考查治疗幽门螺杆菌感染的药物。治疗幽门螺杆菌感染宜选用阿莫西林（C对）。青霉素V（D错）主要用于轻度敏感菌感染，恢复期的巩固治疗和感染复发的预防。双氯西林（A错）主要用于耐青霉素G的金黄色葡萄球菌感染。替卡西林（B错）为广谱的抗生素，特别对铜绿假单胞菌有强大的作用。氨苄西林（E错）用于敏感细菌所致的呼吸道感染、胃肠道感染、尿路感染、软组织感染、心内膜炎、脑膜炎、败血症等 。